能够抗阿米巴、抗滴虫的药物是
A. 青霉素
B. 红霉素
C. 四环素
D. 甲硝唑
E. 先锋霉素

正确答案：D。甲硝唑

解析：甲硝唑（D对）可杀灭溶组织内阿米巴的营养因子，是治疗侵袭性肠道或肝脏阿米巴感染的选用药物，可直接杀灭阴道滴虫，是口服治疗阴道滴虫安全有效的药物。青霉素（A错）抗菌作用强，临床可用于治疗敏感的革兰阳性球菌感染、杆菌、革兰阴性球菌、螺旋体所致的感染，不常用于抗阿米巴、抗滴虫。红霉素（B错）主要用于对青霉素过敏的金黄色葡萄球菌，对军团菌、弯曲杆菌、支原体肺炎、沙眼衣原体所致的婴儿肺炎和结膜炎可作为首选药。四环素（C错）属于快速抑菌剂，高浓度具有杀菌作用，临床主要用于立克次体感染支原体属感染、衣原体属感染，还可首选用于鼠疫、霍乱、布鲁菌病、幽门螺旋杆菌感染引起的消化性溃疡、肉芽肿鞘杆菌感染引起的腹股沟肉芽肿。第一代头孢菌素如头孢氨苄、头孢唑林又称为先锋霉素（E错），对革兰阳性菌作用强，对革兰阴性菌作用弱，不耐酶。